关于孕前保健以下哪项是错误的
A. 从家庭的幸福及优生的目的，应选择理想受孕时机
B. 较为理想的妊娠时机应当选择男女双方、尤其是男方的身体、精神心理均为最佳的时期
C. 妇女一生中有30余年生育期，完全有可能进行受孕时机的选择
D. 婚后打算避孕一段时间再受孕，应该停止避孕前接受孕前保健及指导
E. 做好孕前保健及指导可以避免许多不适宜的妊娠及人工流产

正确答案：B。较为理想的妊娠时机应当选择男女双方、尤其是男方的身体、精神心理均为最佳的时期

解析：本题考查孕前保健的相关内容。妊娠是以女方为主体，应该以女方的身体、精神心理均为最佳的时期较为理想（B错，为本题正确答案）。孕前保健时：从家庭的幸福及优生的目的，应选择理想受孕时机（A对）；做好孕前保健及指导可以避免许多不适宜的妊娠及人工流产（E对）；妇女一生中有30余年生育期，完全有可能进行受孕时机的选择（C对）；婚后打算避孕一段时间再受孕，应该停止避孕前接受孕前保健及指导（D对）等。